生精上皮围成
A. 睾丸网
B. 生精小管
C. 附睾管
D. 输出小管
E. 直精小管

正确答案：B。生精小管

解析：生精小管（B对）由生精上皮围成，其产生精子。